龋病是一种复合因素所引起的疾病，主要是
A. 细菌，酸、牙齿状况
B. 细菌、食物、牙齿状况
C. 细菌、食物，机体状况
D. 细菌，食物、机体和牙齿状况以及致病因素滞留时间

正确答案：D。细菌，食物、机体和牙齿状况以及致病因素滞留时间

解析：本题考查四联因素学说。细菌的存在是龋病发生的先决条件，食物尤其是糖为细菌提供代谢的原料，机体和牙体情况的异常增加了龋病的易感性，宿主牙面上的食物和菌斑经过一定的时间才会发生龋病，细菌，食物、机体和牙齿状况以及致病因素滞留时间是龋病的复合因素（D对ABC错）。